滴虫阴道炎典型的白带性状是
A. 泔水状恶臭白带
B. 白色稠厚凝乳状白带
C. 稀薄脓性泡沫白带
D. 白色均质腥臭白带
E. 大量血性白带

正确答案：C。稀薄脓性泡沫白带

解析：滴虫阴道炎典型的白带性状是稀薄脓性泡沫状白带（C对），分泌物呈脓性是因为含有白细胞，若合并其他感染则呈黄绿色；呈泡沫状、有臭味是因为滴虫无氧酵解碳水化合物，产生腐臭气体所致。泔水状恶臭白带（P306）（A错）多见于子宫颈癌或阴道癌。白色稠厚凝乳状白带（P248）（B错）或豆腐渣样白带见于外阴阴道假丝酵母菌病。白色均质腥臭白带（P251）（D错）多见于细菌性阴道病。大量血性白带（P315）（E错）多见于子宫内膜癌。